性格形成的关键时期
A. 胎儿期
B. 新生儿期
C. 婴儿期
D. 幼儿期
E. 学龄前期

正确答案：E。学龄前期

解析：本题考查小儿年龄分期。学龄前期（E对）智能发育增快，是性格形成的关键时期。